细菌性痢疾属于
A. 变质性炎症
B. 浆液性炎症
C. 纤维素性炎症
D. 蜂窝织炎症
E. 化脓性炎症

正确答案：C。纤维素性炎症

解析：细菌性痢疾初期为急性卡他性炎，后期为特征性假膜性炎，而假膜性炎是指黏膜发生的纤维素性炎（C对），因渗出的纤维素、中性粒细胞和坏死黏膜组织以及病原菌等在黏膜表面形成一层灰白色膜状物而得名。